符合多囊卵巢综合征的表现是
A. PRL正常，FSH﹥40U/L
B. FSH、LH值均﹤5U/L
C. E1/E2﹤1
D. 空腹胰岛素水平降低
E. LH/FSH≥2

正确答案：E。LH/FSH≥2

解析：多囊卵巢综合征患者20～30%的患者可伴有血清PRL轻度增高（A错）。由于垂体对促性腺激素释放激素（GnRH）敏感性增加，分泌过量LH，使LH升高（B错），并刺激卵巢间质、卵泡膜细胞产生过量雄激素，雄激素在外周组织芳香酶的作用下转换为雌酮（E1）。雌激素的负反馈作用使FSH水平相对降低，LH/FSH≥2～3（E对）。雌酮（E1）升高，雌二醇（E2）正常或轻度升高，E1/E2＞1（C错）。约50%患者存在不同程度的胰岛素抵抗及代偿性高胰岛素血症（D错）。